抗过敏药氯苯那敏的慎用人群
A. 高血压者
B. 高钾血症者
C. 乳酸血症者
D. 胰腺炎早期者
E. 甲状腺功能减退症

正确答案：E。甲状腺功能减退症

解析：本题考查氯苯那敏用药禁忌。马来酸氯苯那敏片禁忌人群：癫痫患者、孕妇及哺乳期女性、婴幼儿等，同时甲状腺功能减退症（E对）慎用氯苯那敏。